肺换气时气体通过的部位是
A. 支气管
B. 细支气管
C. 肺泡壁
D. 肺泡小管
E. 呼吸膜

正确答案：E。呼吸膜